下列各项，不属于黄疸辨证要点的是
A. 辨阳黄、阴黄
B. 辨黄疸病势轻重
C. 辨黄疸之部位
D. 辨阴黄之病因
E. 辨阳黄湿热轻重

正确答案：C。辨黄疸之部位

解析：黄疸的辨证，应该辨阳黄、阴黄（A对）；辨阴黄之病因（D对）；辨阳黄湿热之轻重、胆腑郁热及疫毒炽盛（E对）。原文虽未明显提出要辨黄疸病势轻重，但黄疸一般都有身目俱黄，部位不存在辨证价值，故C错，为本题正确答案。